用于区分萘醌和蒽醌的反应是
A. 醋酐反应
B. 三氯乙酸反应
C. 无色亚甲蓝显色试验
D. Molish反应
E. Bornträger's反应

正确答案：C。无色亚甲蓝显色试验

解析：本题考查的是蒽醌类化合物显色反应。用于区分萘醌和蒽醌的反应是无色亚甲蓝显色试验（C对）。无色亚甲蓝显色实验：无色亚甲蓝乙醇溶液（1mg/ml）专用于检出苯醌及萘醌。样品在白色背景下呈现出蓝色斑点，可与蒽醌类区别。醋酐反应（A错）指醋酐-浓硫酸反应，为皂苷类化合物的显色反应。醋酐-浓硫酸（Liebermann-Burchard）反应：将样品溶于醋酐中，加入浓硫酸-醋酐（1：20）数滴，显色，颜色变化与Liebermann反应相同。此反应可以区分三萜皂苷和甾体皂苷，前者最后呈红色或紫色，后者最终呈蓝绿色。三氯乙酸反应（B错）为皂苷类化合物的显色反应。将含甾体皂苷样品的三氯甲烷溶液滴在滤纸上，加三氯乙酸试液1滴，加热至60℃，生成红色渐变为紫色。在同样条件下三萜皂苷必须加热至100℃才能显色，也生成红色渐变为紫色，可用于纸层析。Molish反应（D错）为糖的显色反应，常用的试剂由浓硫酸和α-萘酚组成。可生成有色物质，可借此来检识糖和苷类化合物的存在。Bornträger's反应（E错）：在碱性溶液中，羟基醌类颜色改变并加深，多呈橙、红、紫红及蓝色。如羟基蒽醌类化合物遇碱显红至紫红色，称为Bornträger's反应。